成年人腹股沟管长度应为
A. 2～3cm
B. 4～5cm
C. 6～7cm
D. 8～9cm
E. 10～12cm

正确答案：B。4～5cm

解析：腹股沟管位于腹前外侧壁的下部、腹股沟韧带内侧半的上方，由外上斜向内下，男性的精索或女性的子宫圆韧带由此通过。成年人腹股沟管的长度为4～5cm（B对）。腹股沟管是腹壁的薄弱区，为腹股沟疝的好发部位。